新生儿厌氧菌败血症治疗首选
A. 万古霉素
B. 阿米卡星
C. 甲硝唑
D. 青霉素
E. 氨苄西林

正确答案：C。甲硝唑

解析：新生儿败血症：厌氧菌感染首选甲硝唑（C对）；金黄色葡萄球菌感染用万古霉素（A错）和青霉素（D错）；流感嗜血杆菌感染选用氨苄西林（E错）。阿米卡星肾毒性太大，儿科很少用此药（B错）。